滑石粉可作为
A. 崩解剂
B. 黏合剂
C. 两者均可
D. 两者均不可

正确答案：D。两者均不可

解析：本题考查片剂的常用辅料。滑石粉为常用的润滑剂（广义），不能用作崩解剂和黏合剂（D对）。常用的崩解剂有干淀粉、羧甲淀粉钠（CMS-Na）、低取代羟丙基纤维素（L-HPC）、交联羧甲基纤维素钠（CCMC-Na）、交联聚维酮（PVPP）、泡腾崩解剂等。常用的黏合剂有淀粉浆（常用浓度为8%～15%）、甲基纤维素（MC）、羟丙基纤维素（HPC）、羟丙甲纤维素、羧甲基纤维素钠（CMC-Na）、乙基纤维素（EC）等。